苯在体内的主要蓄积部位是
A. 骨骼
B. 骨髓
C. 脑
D. 肾
E. 血液

正确答案：B。骨髓